处方：维生素C104g，碳酸氢钠49g，亚硫酸氢钠2g，依地酸二钠0.05g，注射用水加至1000ml。下列有关维生素C注射液的叙述错误的是
A. 碳酸氢钠用于调节等渗
B. 亚硫酸氢钠用于调节pH
C. 依地酸二钠为金属螯合剂
D. 在二氧化碳或氮气流下灌封
E. 本品可采用115℃、30min热压灭菌

正确答案：A、B、E。碳酸氢钠用于调节等渗；亚硫酸氢钠用于调节pH；本品可采用115℃、30min热压灭菌

解析：本题考查注射剂常用附加剂。维生素C注射液处方分析：维生素C-主药；依地酸二钠-金属螯合剂（C对）；碳酸氢钠-pH调节剂（A错，为本题正确答案）；亚硫酸氢钠-抗氧剂（B错，为本题正确答案）；注射用水-溶剂。制备：在配制容器中加处方量80%的注射用水，通二氧化碳饱和，加维生素C溶解后，分次缓缓加入碳酸氢钠，搅拌使完全溶解，加入预先配制好的依地酸二钠溶液和亚硫酸氢钠溶液，搅拌均匀，调节药液pH6.0～6.2，添加二氧化碳饱和的注射用水至足量。用垂熔玻璃漏斗与膜滤器过滤，溶液中通二氧化碳，并在二氧化碳或氮气流下灌封（D对），用100℃流通蒸汽灭菌15分钟（E错，为本题正确答案）。